儿童原发性肾病综合征最常见的类型为
A. 微小病变肾病
B. 新月体性肾小球肾炎
C. IgA肾病
D. 毛细血管内增生性肾小球肾炎
E. 膜性肾病

正确答案：A。微小病变肾病

解析：微小病变肾病（A对）是儿童原发性肾病综合征最常见的病理类型。膜性肾病（膜性肾小球病）（E错）是成年人原发性肾病综合征最常见的病理类型。新月体性肾小球肾炎（B错）、IgA肾病（C错）和毛细血管内增生性肾小球肾炎（急性弥漫性增生性肾小球肾炎）（D错）均不是肾病综合征的类型。